医德规范是指导医务人员进行医疗活动的
A. 思想准则
B. 行为准则
C. 技术规程
D. 技术标准
E. 思想和行为准则

正确答案：E。思想和行为准则

解析：医德规范为医务人员提供行为准则，提升其职业精神，是指导医务人员进行医疗活动的思想和行为准则（E对AB错）。